酚妥拉明对心脏的药理作用除外的是
A. 可抑制心脏兴奋
B. 加快心率
C. 酚妥拉明具有阻断K+通道的作用
D. 使心肌收缩力增强
E. 心排出量增加

正确答案：A。可抑制心脏兴奋

解析：酚妥拉明对心脏的药理作用：可兴奋心脏，使心肌收缩力增强，心率加快，心排出量增加。这种兴奋作用部分由血管舒张、血压下降，反射性兴奋交感神经引起；部分是阻断神经末梢突触前膜α2受体，从而促进去甲肾上腺素释放，激动心脏β1受体的结果。此外，酚妥拉明尚具有阻断K+通道的作用。掌握“α肾上腺素受体阻断剂”知识点。